剥脱性龈病损可能是下列疾病的表征，但不包括
A. 天疱疮
B. 类天疱疮
C. 白斑
D. 扁平苔癣
E. 红斑狼疮

正确答案：C。白斑

解析：本题考查有剥脱性龈病损的口腔黏膜病。剥脱性龈病损可能是下列疾病的表征，但不包括白斑（C错，为本题的正确答案）。白斑是口腔黏膜上不能被擦去的白色病损，不存在剥脱性病损。牙龈的剥脱性损害是一种非特异性的临床表现，可由多种疾病引起，如糜烂型口腔扁平苔癣、天疱疮、瘢痕类天疱疮、内分泌紊乱、超敏反应等。天疱疮（A对）揭皮试验阳性，口腔黏膜呈剥脱性龈损害。类天疱疮（B对）的损害可以发生于口腔的任何部位，但以牙龈最为多见，而牙龈最典型的表现呈剥脱性龈炎样损害。扁平苔癣（D对）的牙龈表面常发生糜烂，似上皮缺失，呈剥脱性龈炎样表现。红斑狼疮（E对）的黏膜病损好发于下唇唇红，呈圆形或卵圆形红斑或糜烂，中央凹陷，呈剥脱性龈炎样损害。